又经X线影像见骨折端有分离。其最可能的后果是
A. 桡神经损伤
B. 肩关节强直
C. 肘关节僵直
D. 损伤性骨化
E. 骨折不愈合

正确答案：E。骨折不愈合

解析：患者中年男性，左上肢摔伤，急诊来院。X线摄片显示肱骨干横行骨折，并有移位，经手法复位不理想，后改为牵引治疗， 又经X线影像见骨折端有分离（未形成连续骨折线）。其最可能的后果是骨折不愈合（E对）。桡神经损伤（A错）在肱骨中下1/3处贴近骨干，此处肱骨骨折时桡神经易受损伤。肩关节强直（B错）、肘关节僵直（C错）表现为晨僵与腰部肌肉韧带压痛点，与骨折后复位不好无明确关联。损伤性骨化（D错）是关节脱位、关节邻近骨折及严重关节扭伤后， 由于骨膜剥离后，骨膜下血肿与软组织血肿相连。若处理不当，血肿较大、经机化、钙化、骨化后，在关节邻近的软组织内可有广泛的钙化或骨化组织，影响关节的活动功能。多见在肘关节部位。